下列有关定性研究的描述，正确的是
A. 结果可外推
B. 结果多用概率统计方法
C. 结果很少用概率统计方法
D. 注重事物的结果
E. 在较短的时间内可获得所需资料

正确答案：C。结果很少用概率统计方法